患者，男，18岁。发热恶寒，鼻塞头痛，咽部红肿，口干溲黄，舌苔薄黄，脉数有力。用药宜首选
A. 荆芥防风
B. 桑叶菊花
C. 葛根升麻
D. 柴胡黄芩
E. 金银花连翘

正确答案：E。金银花连翘

解析：金银花功效清热解毒，疏散风热，治温病初起，身热头痛，咽痛口渴，常与连翘、薄荷、牛蒡子等同用，如银翘散（《温病条辨》）（E对）。荆芥治疗风寒感冒，恶寒发热、头痛无汗者，常与防风、羌活、独活等药同用，如荆防败毒散（《摄生众妙方》）（A错）。桑叶治疗风热感冒，或温病初起，温热犯肺，发热、咽痒、咳嗽等症，常与菊花相须为用，并配伍连翘、薄荷、桔梗等药，如桑菊饮（《温病条辨》）（B错）。葛根治麻疹初起，表邪外束，疹出不畅，常与升麻、芍药、甘草等同用，如升麻葛根汤（《阎氏小儿方论》）（C错）。若外感风寒，寒邪入里化热，恶寒渐轻，身热增盛者，柴胡多与葛根、黄芩、石膏等同用，以解表清里，如柴葛解肌汤（《伤寒六书》）（D错）。